进口下列，应当经国务院卫生主管部门批准，但不包括
A. 人体血液
B. 人体血浆
C. 人体组织
D. 人体细胞
E. 人体血液制品

正确答案：E。人体血液制品